叶先端钝尖，基部楔形，边缘具钝锯齿；蒴果长圆形，常3裂，分果瓣船形的饮片是
A. 紫花地丁
B. 鱼腥草
C. 肉苁蓉
D. 车前草
E. 蒲公英

正确答案：A。紫花地丁

解析：本题考查的是紫花地丁饮片的性状鉴别。叶先端钝尖，基部楔形，边缘具钝锯齿；蒴果长圆形，常3裂，分果瓣船形的饮片是紫花地丁（A对）。紫花地丁：【性状鉴别】饮片为不规则的段。主根长圆锥形；淡黄棕色，有细纵皱纹。叶基生，灰绿色，展平后叶片呈披针形或卵状披针形；先端钝，基部截形或稍心形，边缘具钝锯齿，两面有毛；叶柄细，上部具明显狭翅。花茎纤细；花瓣5，紫堇色或淡棕色；花距细管状。蒴果椭圆形或3裂，种子多数，淡棕色。气微，味微苦而稍黏。鱼腥草（B错）：【性状鉴别】饮片鲜鱼腥草茎呈圆柱形；上部绿色或紫红色，下部白色，节明显，下部节上生有须根，无毛或被疏毛。叶互生，叶片心形；先端渐尖，上表面绿色，密生腺点，下表面常紫红色；叶柄细长，基部与托叶合生成鞘状。穗状花序顶生。具鱼腥气，味涩。肉苁蓉（C错）：【性状鉴别】饮片肉苁蓉片呈不规则形的厚片。表面棕褐色或灰棕色。有的可见肉质鳞叶。切面有淡棕色或棕黄色点状维管束，排列成波状环纹。气微，味甜、微苦。车前草（D错）：【性状鉴别】饮片为不规则的段。根须状或直而长。叶片皱缩，多破碎，表面灰绿色或污绿色，脉明显。可见穗状花序。气微，味微苦。蒲公英（E错）：【性状鉴别】饮片为不规则的段。根表面棕褐色，抽皱；根头部有棕褐色或黄白色的茸毛，有的已脱落。叶多皱缩破碎，绿褐色或暗灰绿色，完整者展平后呈倒披针形，先端尖或钝，边缘浅裂或羽状分裂，基部渐狭，下延呈柄状。头状花序，总苞片多层，花冠黄褐色或淡黄白色。有时可见具白色冠毛的长椭圆形瘦果。气微，味微苦。